下列各项中，属于相乘传变的是
A. 肺病及肾
B. 肺病及心
C. 心病及肝
D. 肝病及肾
E. 脾病及肾

正确答案：E。脾病及肾

解析：本题考查五行学说的基本内容和其在生理病理方面的应用。五脏配属五行：肝属木，心属火，脾属土，肺属金，肾属水。而五行相生的次序是木生火、火生土、土生金、金生水、水生木。其中生我者为母，我生者为子。母病及子即病变从母脏传来，并依据相生方向侵及属子的脏腑。肺属金，肾属水，金生水，故肺为肾之母，肺病及肾属母病及子（A错）。肺属金，心属火，根据五行相克，火克金。相侮传变即反克为害，病变由被克脏腑传来。肺病及心属相侮传变（B错）。心属火，肝属木，木生火，心为肝之子，心病及肝属子病及母（C错）。肝属木，肾属水，水生木，肝为肾之子。子病及母即病变从子脏传来，侵及属母的脏腑。肝病及肾属于子病及母（D错）。脾属土，肾属水，土克水。相乘传变即相克太过而导致的疾病传变，病变从相克方面传来，侵及被制脏腑。脾病及肾属于相乘传变（E对）。